脊髓外形的描述，哪项错误
A. 表面有6条纵沟
B. 呈前后略扁的圆柱状
C. 上、下有两处膨大，上为颈膨大，下为腰骶膨大
D. 下端呈圆锥状，称脊髓圆锥
E. 脊髓圆锥与马尾相连

正确答案：E。脊髓圆锥与马尾相连

解析：脊髓表面有6条平行的纵沟（A对），为前正中裂,后正中沟，这两条纵沟将脊髓分为左右对称的两半。，脊髓的前外侧面有1对前外侧沟，后外侧面有1对后外侧沟，此外，在颈髓和胸髓上部，后正中沟和后外侧沟之间，还有一条较浅的后中间沟。脊髓呈前、后稍扁的圆柱形（B对），全长粗细不等，有两个梭形膨大部（C对）。上方的称颈膨大,从第4颈髓节段至第1胸髓节段。下方的称腰骶膨大,从第1腰髓节段至第3骶髓节段。脊髓上端在枕骨大孔处与延髓相连，下端变细呈圆锥状称脊髓圆锥（D对）。马尾位于脊髓圆锥的下方（E错，为本题正确选项）。